女，35岁。近3年来持续表现入睡困难，精力疲乏，常感头晕，头痛，无愉快感，悲观失落，不愿意主动与人交往，无兴奋许多和自我评价高，无晨重夜轻节律变化，无消极自杀观念和行为。该患者最可能的诊断是
A. 睡眠障碍
B. 社交焦虑障碍
C. 环性心境障碍
D. 单相抑郁障碍
E. 恶劣心境

正确答案：A。睡眠障碍

解析：中年女性患者，近3年来持续表现入睡困难，精力疲乏，常感头晕，头痛，无愉快感，悲观失落，不愿意主动与人交往等（睡眠障碍的临床表现）。失眠症是睡眠障碍的一种，常表现为入睡困难，精力疲乏，由失眠还可引起患者焦虑，抑郁情绪低落，不愿和人交往等表现，根据该患者病史和临床表现，考虑诊断为睡眠障碍（A对）。社交焦虑障碍（B错），又称社交恐惧症，主要表现为显著而持续地害怕在公众面前可能出现羞辱和尴尬的社交行为，担心别人会嘲笑自己，在社交场合持续紧张或恐惧。环性心境障碍（C错）是指反复出现轻度心境高涨或低落。单相抑郁障碍（D错），以显著而持久的心境低落为主要特征，临床表现从闷闷不乐到悲痛欲绝，可有消极自杀观念和行为。恶劣心境（E错），是一种以持久的心境低落为主的轻度抑郁，常表现为多愁善感，郁郁寡欢，内向。